对于预防性生物制品，其直接接触内包装的外包装标签内容包括
A. 药品名称
B. 禁忌症
C. 接种对象
D. 适应症
E. 不良反应

正确答案：A、B、C、E。药品名称；禁忌症；接种对象；不良反应